下列属于牙源性囊肿的是
A. 球上颌囊肿
B. 始基囊肿
C. 鼻唇囊肿
D. 上颌正中囊肿
E. 鳃裂囊肿

正确答案：B。始基囊肿

解析：牙源性颌骨囊肿根据其来源不同可分为以下几种：根端囊肿、始基囊肿、含牙囊肿、牙源性角化囊性瘤（牙源性角化囊肿）。掌握“牙源性颌骨囊肿”知识点。